月经周期正常，经期延长，经血量多，应诊断为
A. 萎缩型子宫内膜
B. 子宫内膜腺囊型增生过长
C. 黄体功能不全
D. 黄体萎缩不全
E. 子宫内膜非典型性增生

正确答案：D。黄体萎缩不全

解析：黄体萎缩不全（D对）又称子宫内膜不规则脱落，表现为月经周期正常，但经期延长，长达9～10日，且出血量多。萎缩型子宫内膜（A错）、子宫内膜腺囊型增生过长（B错）、子宫内膜非典型性增生（E错）为无排卵性功血的病理改变，临床上最常见的症状是子宫不规则出血，表现为月经周期紊乱，经期长短不一，经量不定或增多。黄体功能不全（P350）（C错）常见于生育年龄妇女，常表现为月经周期缩短，不孕或早孕时流产。